在振动的物理参数中，（）与振动对人体作用的关系最密切
A. 位移
B. 速度
C. 加速度
D. 振动时间

正确答案：C。加速度

解析：本题考查振动的物理参数。在位移、速度和加速度三个振动物理量中，反映振动强度对人体作用关系最密切的是振动加速度（C对ABD错）。振动对人体健康的影响除与振动的强度（位移、速度和加速度）有关外，还取决于机体对不同频率振动感受特性和接触时间。